患者，男性，45岁。右下6可见大面积银汞充填，远中食物嵌塞，温度测试无活力。若此牙为死髓牙，牙冠缺损3/4，未行根管治疗，根长，粗大，牙槽骨条件好。最佳设计方案是
A. 根管治疗后全冠修复
B. 根管治疗后银汞充填加全冠修复
C. 根管治疗后铸造桩核加全冠修复
D. 根管治疗后嵌体修复
E. 高嵌体修复

正确答案：C。根管治疗后铸造桩核加全冠修复

解析：本题考查桩核冠的适应证。患者男，右下6可见大面积银汞充填（牙体缺损），远中食物嵌塞，温度测试无活力。若此牙为死髓牙，牙冠缺损3/4（中度以上缺损），未行根管治疗，根长，粗大（根管桩道良好），牙槽骨条件好。最佳设计方案是根管治疗后铸造桩核加全冠修复（C对）。当剩余的可利用牙体组织高度不足，无法形成足够的全冠固位形时，通常需要桩核来为最终全冠修复体提供支持和固位，即桩核冠。牙体缺损修复方法应根据缺损范围小到大选择，选择顺序为：嵌体→冠→桩核冠。桩核冠修复前应行完善的根管治疗，根管治疗效果肯定时再行修复。根管治疗后全冠修复（A错）不适用牙体无足够固位形、抗力形者，应采取辅助固位与抗力措施后再修复。根管治疗后银汞充填加全冠修复（B错）的银汞充填无法为全冠修复提供足够的支持和固位，不适用于本病例。根管治疗后嵌体修复（D错）适用于牙体缺损，经牙体预备后，剩余牙体组织仍可耐受胎力而不致折裂，并能为嵌体提供足够固位时，否则应考虑其他的修复形式。高嵌体修复（E错）适用于后牙的多面嵌体，以及牙合面较大范围缺损（如牙尖缺损）需要恢复牙合面外形及咬合接触，同时有完整的颊舌壁可保留者。